脊髓蛛网膜
A. 位于软脊膜的内面
B. 位于硬脑膜的外面
C. 其外面有脑脊液流动
D. 与硬脊膜之间有终池
E. 与软脊膜之间的间隙称蛛网膜下隙

正确答案：E。与软脊膜之间的间隙称蛛网膜下隙

解析：脊髓蛛网膜位于软脊膜的外面（A错）、硬脑膜的内面（B错）。脊髓蛛网膜与软脊膜之间的间隙（E对）称蛛网膜下隙，间隙（即脊髓蛛网膜内面）内充满脑脊液（C错），脊髓蛛网膜下隙的下部，自脊髓下端至第2骶椎之间扩大的蛛网膜下隙，称终池 , 内容马尾（D错）。